解救有机磷中毒过程中，如阿托品应用过量，应立刻给予
A. 毛果芸香碱
B. 东莨菪碱
C. 麻黄碱
D. 山莨菪碱
E. 茶碱

正确答案：A。毛果芸香碱

解析：本题考查有机磷中毒解救。解救有机磷中毒过程中，如阿托品应用过量，应立刻给予毛果芸香碱（A对）。患者如出现澹妄、躁动、幻觉、全身潮红、高热、心率加快甚至昏迷时，则为阿托品中毒，应立即停用阿托品，并可用毛果芸香碱解毒，但不宜使用毒扁豆碱。